皮瓣包括
A. 表皮层
B. 表皮层+部分真皮层
C. 表皮层+真皮全层
D. 表皮层+真皮最上层乳突层
E. 皮肤的全厚层+皮下组织

正确答案：E。皮肤的全厚层+皮下组织

解析：本题考查皮瓣移植。皮瓣包括皮肤的全厚层+皮下组织（E对）。与游离皮片移植不同的是，皮瓣必须有与机体皮肤相连的蒂，或行血管吻合，血液循环重建后供给皮瓣的血供和营养，才能保证移植皮瓣的成活。前者称为带蒂皮瓣移植；后者则称为游离皮瓣移植，或血液循环重建血管化游离皮瓣移植。